人体氟可来源于
A. 饮水
B. 空气
C. 食物
D. 局部涂氟
E. 以上说法均正确

正确答案：E。以上说法均正确

解析：人体氟大部分来源于摄入的食品和水。如：饮水；食物；空气；其他可能的氟来源。掌握“人体氟摄入及代谢、氟防龋”知识点。